雌激素的周期性变化，下列哪项是错误的
A. 在卵泡开始发育时，雌激素分泌量很少
B. 排卵前形成一个高峰
C. 排卵后分泌稍微减少
D. 在月经前达最低水平
E. 在排卵后10～12日黄体成熟时，形成又一高峰

正确答案：E。在排卵后10～12日黄体成熟时，形成又一高峰

解析：黄体体积和功能在排卵后7～8日（相当于月经周期第22日）达高峰，直径1～2cm，外观色黄。掌握“女性生殖系统生理”知识点。